前列腺癌T1a期患者需要采取的治疗措施为
A. 不作处理，观察
B. 部分切除术
C. 根治性切除术
D. 化疗
E. 放疗

正确答案：A。不作处理，观察